男，58岁，高血压病史多年，临床：全口牙龈边缘及牙龈乳头充血水肿，牙龈增生覆盖牙冠的1/2，下前牙出现松动移位。最有可能的诊断是
A. 肥大性龈炎
B. 牙龈纤维瘤病
C. 快速进展型牙周炎
D. 药物性牙龈增生
E. 牙间乳头炎

正确答案：D。药物性牙龈增生

解析：本题考查药物性牙龈肥大。根据病例描述，患者有高血压病史，全口牙龈边缘及牙龈乳头充血水肿，牙龈增生覆盖牙冠的1/2，下前牙出现松动移位，可知患者的牙龈肥大增生且伴有明显的牙龈炎症，考虑是由于服用钙通道阻滞剂型的降压药而导致的，故最有可能的诊断为药物性牙龈增生（D对）。肥大性龈炎（A错）是以牙龈增生为主要表现的慢性龈炎，增生程度较轻，覆盖牙冠一般不超过1/3，有明显的局部刺激因素，无长期服药史，故不考虑此诊断。牙龈纤维瘤病（B错）牙龈增生程度较重，增生牙龈一般覆盖牙冠的2/3以上，伴发的慢性龈炎较少且程度轻，病例中牙龈炎症明显，故不考虑此诊断。快速进展型牙周炎（C错）主要表现为牙槽骨的快速吸收，牙齿松动明显，病程进展快，一般不伴有牙龈的增生表现。牙间乳头炎（E错）是局部的机械或化学刺激，如食物嵌塞、不适当地使用牙签、充填体悬突、不良修复体等刺激牙龈导致的急性非特异性炎症，主要表现为牙龈乳头发红肿胀，探触和吸吮时易出血，有自发性的胀痛和明显的探触痛，一般不表现为牙龈增生。